初次诊断活动期十二指肠溃疡，下列治疗中最适合的是
A. 联合应用两种黏膜保护剂
B. 促动力剂+H₂受体拮抗剂
C. 质子泵抑制剂+粘膜保护剂
D. 质子泵抑制剂+两种抗生素
E. 抗酸剂

正确答案：D。质子泵抑制剂+两种抗生素

解析：十二指肠溃疡患者的Hp（幽门螺杆菌）感染率高达90％～100％。初次诊断活动期十二指肠溃疡，应首选根除幽门螺杆菌的治疗。常用的联合方案有：质子泵抑制剂（1种PPI）+两种抗生素（D对）或1种铋剂+2种抗生素。